临床行气管切开时应注意，气管切开一般在
A. 第1气管软骨环
B. 第1～2气管软骨环
C. 第3～5气管软骨环
D. 第5～6气管软骨环
E. 第6～8气管软骨环

正确答案：C。第3～5气管软骨环

解析：气管颈段位于肌三角内，上接环状软骨，下平胸骨颈静脉切迹与气管胸段相延续，长约6.5cm，有6～8个气管软骨环。临床行气管切开时注意点，一般在第3～5气管软骨环的范围内切开。掌握“气管颈段、颈动脉三角的解剖特点及临床应用”知识点。